胸部X线片示心影呈“烧瓶样”。提示的心脏异常是
A. 二尖瓣狭窄
B. 二尖瓣关闭不全
C. 主动脉瓣关闭不全
D. 心包积液
E. 主动脉瓣狭窄

正确答案：D。心包积液

解析：胸部X线片示心影呈“烧瓶样”，提示的心脏异常是心包积液（D对）。二尖瓣狭窄（A错）时，心脏舒张期从左心房流入左心室的血流受阻，左心房代偿性扩张肥大，晚期左心室缩小，X线显示呈“梨形心”（九版病理学P172）。二尖瓣关闭不全（B错）时，左心室部分血液通过未关闭全的瓣膜口反流到左心房内，左心房既接受肺静脉的血液，又接受左心室反流的血液，致左心房血容量较正常增多，出现左心房代偿性肥大，继而左心房、左心室容积性负荷增加，使左心室代偿性肥大，右心室、右心房代偿性肥大，X线显示呈“球形心”（九版病理学P172）。主动脉瓣关闭不全（C错）时，主动脉部分血液反流至左心室，使左心室血容量增加，发生代偿性肥大。久而久之，发生左心衰竭，进而引起右心肥大，大循环淤血（九版病理学P173）。主动脉瓣狭窄（E错）左心室血液排血受阻，左心室发生代偿性肥大，X线显示，心脏呈“靴形”（九版病理学P173）。